孕早期心脏病患者，决定是否能继续妊娠的最重要依据是
A. 心脏病种类
B. 心脏病变部位
C. 心功能分级
D. 症状严重程度
E. 有否以往生育史

正确答案：C。心功能分级